不属烷化剂的抗肿瘤药
A. 氮芥
B. 白消安
C. 卡莫司汀
D. 甲氨蝶呤
E. 塞替派

正确答案：D。甲氨蝶呤

解析：本题考查烷化剂类抗肿瘤药。不属烷化剂的抗肿瘤药是甲氨蝶呤（D错，为本题正确答案）。甲氨蝶呤为抗代谢药。破坏DNA的烷化剂分为氮芥类、塞替派类、亚硝脲类、甲磺酸酯类等，常用药品包括氮芥（A对）、环磷酰胺、赛替派（E对）、白消安（B对）、卡莫司汀（C对）等。